婴幼儿化脓性淋巴结炎常引发什么感染
A. 牙源性
B. 血源性
C. 损伤性
D. 腺源性
E. 医源性

正确答案：D。腺源性

解析：本题考查婴幼儿化脓性淋巴结炎引发的感染。腺源性（D对）感染常见于口腔、上呼吸道感染继发淋巴结感染，引起筋膜间隙的蜂窝织炎，如婴幼儿化脓性淋巴结炎。口腔颌面部感染中，牙源性（A错）是病原菌通过病变牙或牙周组织进入人体发生的感染。血源性（B错）感染是机体其他部位化脓性病灶通过血液循环引起口腔颌面部化脓性病变。损伤性（C错）感染是继发于损伤后发生的感染。医源性（E错）感染常见于局麻、手术、穿刺等操作未严格遵守无菌技术造成继发性感染。